瘿痈风热痰凝证的主方
A. 通窍活血汤
B. 海藻玉壶汤
C. 牛蒡解肌汤
D. 柴胡舒肝汤
E. 四海舒郁丸

正确答案：C。牛蒡解肌汤

解析：通窍活血汤适用于石瘿瘀热伤阴证（A错）。海藻玉壶汤适用于肉瘿气滞痰凝证（B错）。牛蒡解肌汤适用于瘿痈风热痰凝证（C对）。柴胡舒肝汤适用于瘿痈气滞痰凝证（D错）。四海舒郁丸适用于气瘿肝郁气滞证（E错）。